以下哪项不属于问诊中疼痛的发作方式
A. 自发痛
B. 咬合痛
C. 咀嚼痛
D. 触叩痛
E. 锐痛

正确答案：E。锐痛

解析：疼痛的发作方式：自发痛和激发痛、咬合痛、触叩痛、咀嚼痛。掌握“牙髓病检查方法及诊断程序”知识点。